患者家属加入医患关系中带来的负面效应是
A. 加重了医务人员的责任
B. 增加了对医务人员的监督
C. 有时会损害患者正当权益
D. 出现了从属关系
E. 加大了社会意义

正确答案：C。有时会损害患者正当权益